三叉神经运动核位于
A. 舌下神经核
B. 脑桥
C. 延髓
D. 脊髓
E. 小脑

正确答案：B。脑桥

解析：三叉神经运动核位于脑桥（B对）中部网状结构的背外侧。